初期见高热口渴汗多脉洪数，后期神疲嗜睡食少咽干舌嫩红无苔脉细数，属于
A. 真实假虚
B. 实证转虚
C. 真虚假实
D. 虚证转实
E. 虚实夹杂

正确答案：B。实证转虚

解析：邪正斗争，病情日久不愈，或失治误治，正气伤而不足以御邪，则可形成实证转化为虚证；患者先是出现高热口渴，汗出，脉洪数的实热症状，久治不愈，导致津伤气耗，出现神疲嗜睡，食少咽干，舌嫩红无苔，脉细数的虚象；故其临床意义为实证转虚（B对）。真实假虚证是指疾病的本质为实证，却出现某些“虚羸”的现象，即所谓“大实有羸状”（A错）。真虚假实证是指疾病的本质为虚证，反出现某些“盛实”的现象，即所谓“至虚有盛候”（C错）。虚证转实指正气不足，脏腑机能衰退，组织失却濡润充养，或气机运化无力，以致气血阻滞，病理产物蓄积，邪实上升为矛盾的主要方面，而表现以实为主的证（D错）。虚实夹杂是指在同一患者身上，既有虚证，又有实证的情况（E错）。